某省医学院的刘教授计划与附属医院的张医师共同对一种治疗肝癌新药的疗效进行研究。初步观察显示：新药与传统抗肝癌药在延长肝癌患者生存时间方面无明显差别，但在改善临床症状方面效果要优于传统抗肝癌药，若要更全面地比较此抗肝癌新药和传统常规抗肝癌药的疗效，应选择的研究指标是
A. 比较新药组和常规药组的治愈率
B. 比较新药组和常规药组的死亡率
C. 比较新药组和常规药组的并发症发生率
D. 比较新药组和常规药组的SF-36量表分数
E. 比较新药组和常规药组的生存率

正确答案：D。比较新药组和常规药组的SF-36量表分数